苯急性毒作用主要影响
A. 造血系统
B. 消化系统
C. 中枢神经系统
D. 呼吸系统
E. 内分泌系统

正确答案：C。中枢神经系统

解析：急性苯中毒是由于短时间吸入大量苯蒸汽引起。主要表现为中枢神经系统（C对）的麻醉作用。轻者出现兴奋、欣快感、步态不稳，以及头晕、头疼、恶心、呕吐，轻度意识模糊等。重者神志模糊加重，由浅昏迷进入深昏迷状态或出现抽搐。严重者致呼吸、心跳停止。苯中毒有消化系统（B错）、内分泌系统（E错）、呼吸系统（D错）的表现。慢性苯中毒以造血系统（A错）损害为主。